莱菔子的主治病证是
A. 食积兼脾虚
B. 食积兼瘀血
C. 食积兼虫积
D. 食积兼气滞
E. 食积兼遗尿

正确答案：D。食积兼气滞

解析：本题考查的是莱菔子的主治病证。莱菔子的主治病证是食积兼气滞（D对）。莱菔子：【主治病证】（1）食积气滞之脘腹胀满。（2）痰涎壅盛之气喘咳嗽。稻芽：【主治病证】（1）食积证。（2）脾虚食少证（A错）。山楂：【主治病证】（1）食滞不化，肉积不消，泻痢腹痛。（2）瘀血（B错）痛经、闭经，产后瘀阻腹痛，胸痹心痛。（3）疝气偏坠胀痛。牵牛子：【主治病证】（1）水肿，鼓胀，痰饮喘满。（2）大便秘结，食积停滞。（3）虫积（C错）腹痛。鸡内金：【主治病证】（1）食积不化，消化不良，小儿疳积。（2）遗尿（E错），遗精。（3）泌尿系或肝胆结石症。